下列关于与疾病发生有关的外环境的叙述，错误的是
A. 气候因素
B. 地域因素
C. 生活环境
D. 工作场所
E. 外界精神刺激

正确答案：E。外界精神刺激

解析：本题考查环境与发病的关系。四时气候的异常变化，是孳生和传播邪气，导致疾病发生的条件，故易形成季节性的多发病（A对）。不同地域，其气候特点、水土性质、生活习俗各有所不同，均可影响人群的生理特点和疾病的发生，易致地域性的多发病和常见病（B对）。生活和工作环境的不良，亦可成为疾病发生的因素而致病（CD对）,如工作环境中的废气、废液、废渣、噪声，均可成为直接的致病因素，造成某些严重的疾病，或急性、慢性中毒。生活居住条件差，阴暗潮湿、空气秽浊、蚊蝇孳生等，也是导致疾病发生和流行的条件。外界的精神刺激影响情志变化，影响内环境的协调平衡，而不是外环境（E错）。